小儿外感风寒常见到的指纹是
A. 指纹淡白
B. 指纹色青
C. 指纹鲜红
D. 指纹紫红
E. 指纹紫黑

正确答案：C。指纹鲜红

解析：紫热红伤寒，青惊白是疳，黑时因中恶，黄即困脾端，指纹色鲜红多表示有外感风寒（C对）；指纹淡白多表示有疳积（A错）；指纹色青主疼痛，惊风（B错）；指纹紫红主内热证（D错）；指纹紫黑主血络郁闭（E错）。